下列情况可引起语音震颤增强，除了
A. 大叶性肺炎
B. 肺梗死
C. 肺内大空腔
D. 大量胸腔积液
E. 肺脓肿

正确答案：D。大量胸腔积液

解析：语音震颤操作方法是：病人发出声音，音波产生的震动，沿着气管、支气管及肺泡，传到胸壁引起共鸣的震动，检查者用手触知，感受震颤变化。语音震颤的强弱取决于气管、支气管是否通畅，胸壁传导是否良好。大叶性肺炎（A对）、肺梗死（B对）时，肺组织实变，传导良好，语颤增强。肺内大空腔（C对）、肺脓肿（E对）时，肺内产生空腔，声波在空腔产生共鸣，利于声波传导。大量胸腔积液时，液体的集聚一定程度上阻止了声波的传播语音，语颤减弱（D错，为本题正确答案）。